药品说明书上未收载的不良反应属于
A. 可疑不良反应
B. 一般不良反应
C. 严重不良反应
D. 罕见不良反应
E. 新的不良反应

正确答案：E。新的不良反应

解析：本题考查的是不良反应的相关定义。药品说明书上未收载的不良反应属于新的不良反应（E对）。（1）新的不良反应是指药品说明书中未载明的不良反应。说明书中已有描述，但不良反应发生的性质、程度、后果或者频率与说明书描述不一致或者更严重的，按照新的药品不良反应处理。（2）严重的不良反应（C错）是指因使用药品引起以下损害情形之一的反应：①导致死亡；②危及生命；③致癌、致畸、致出生缺陷；④导致显著的或者永久的人体伤残或者器官功能的损伤；⑤导致住院或者住院时间延长；⑥导致其他重要医学事件，如不进行治疗可能出现上述所列情况的。